左侧皮质核束支配
A. 双侧疑核
B. 双侧动眼神经核
C. 双侧面神经核上半
D. 对侧舌下神经核
E. 以上均正确

正确答案：E。以上均正确

解析：因为面神经核下部和舌下神经核只接受单侧（对侧）皮质核束支配，所以只接受对侧皮质核束的脑神经核为面神经核下部（C对）、舌下神经核（D对）、双侧疑核（A对）、双侧动眼神经核（B对，E为本题正确答案）。